苯的慢性毒作用主要影响
A. 心血管系统
B. 消化系统
C. 内分泌系统
D. 造血系统
E. 中枢神经系统

正确答案：D。造血系统

解析：本题考查苯的慢性中毒作用。苯的慢性中毒作用会对机体多个系统产生损害。慢性苯中毒主要是影响造血系统（D对ABCE错）的功能；慢性苯中毒作用于神经系统常会导致非特异性神经衰弱综合征。